女，68岁。双下肢及颜面水肿1周，尿蛋白8.8g/24h。肾活检病理诊断为膜性肾病。对其主要治疗应是
A. 强的松足量足疗程治疗
B. 强的松联合环磷酰胺治疗
C. 硫唑嘌呤治疗
D. 静脉输注白蛋白
E. 口服血管紧张素转换酶抑制剂

正确答案：B。强的松联合环磷酰胺治疗

解析：患者诊断为膜性肾病，尿蛋白8.8g/24h，属于原发性膜性肾病高危组标准（尿蛋白＞8g/L），应使用糖皮质激素联合细胞毒性药物治疗（B对）。糖皮质激素（如强的松）或细胞毒性药物（如硫唑嘌呤）单独应用对膜性肾病疗效不如激素联合细胞毒性药物（AC）。尽管膜性肾病患者尿蛋白大量丢失，但静脉输注白蛋白（D错）会加重蛋白尿并促进肾脏病变进展，故目前一般不主张应用。血管紧张素转换酶抑制剂（E错）可有效控制高血压并减少尿蛋白（P476），可以作为辅助治疗，但不作为主要治疗。